可出现Homans征阳性的疾病是
A. 动脉硬化性闭塞症
B. 雷诺综合征
C. 下肢深静脉血栓形成
D. 血栓闭塞性脉管炎
E. 单纯性下肢静脉曲张

正确答案：C。下肢深静脉血栓形成

解析：Homans试验又称踝关节过度背曲试验，阳性表现为下肢伸直时，将踝关节迅速背曲，导致腓肠肌和比目鱼肌被动伸长，出现小腿深部肌肉疼痛。可出现Homans征阳性的疾病是下肢深静脉血栓形成（C对）。